下列说法中，不恰当的一项是
A. 恒牙颈嵴突起特别明显
B. 乳磨牙根干短，根分叉大
C. 乳牙牙冠颈嵴突出，冠根分明
D. 恒牙牙冠颈部缩窄，形态上与牙根的分界不大明显
E. 乳牙颈嵴突起明显

正确答案：A。恒牙颈嵴突起特别明显

解析：本题考查乳牙与恒牙的形态特点。恒牙颈嵴突起特别明显（A错，为本题正确答案）不符合乳牙与恒牙的形态特点。在乳牙与恒牙的比较中，乳牙颈嵴突起明显，相对而言，恒牙颈嵴突出不明显。乳牙呈乳白色，体积较同名恒牙小，牙冠短而宽，颈部缩窄，牙根明显缩小，颈嵴突出（E对），冠根分明（C对），恒牙则冠根边界不太明显（D对）。乳磨牙根干特短，分叉度特大（B对），上颌乳磨牙为三根，即近、远中颊根和舌根，下颌乳磨牙为二根，即近中根和远中根。